《国家药品安全“十二五”规划》确定的发展目标包括
A. 生物制品全部达到国际标准
B. 中药标准主导国际标准制定
C. 药品经营企业100%符合《药品经营质量管理规范》要求
D. 新开班的零售药店必须配备执业药师
E. 药品生产100%符合2010年修订的《药品生产质量管理规范》要求

正确答案：B、C、D、E。中药标准主导国际标准制定；药品经营企业100%符合《药品经营质量管理规范》要求；新开班的零售药店必须配备执业药师；药品生产100%符合2010年修订的《药品生产质量管理规范》要求

解析：本题考查国家药品安全“十二五”规划指标。国家药品安全“十二五”规划指标：（1）全部化学药品、生物制品标准达到或接近国际标准，中药标准主导国际标准制定（B对）。医疗器械采用国际标准的比例达到90%以上。（2）2007年修订的《药品注册管理办法》施行前批准生产的仿制药中，国家基本药物和临床常用药品质量达到国际先进水平。（3）药品生产100%符合2010年修订的《药品生产质量管理规范》要求（E对）；无菌和植入性医疗器械生产100%符合《医疗器械生产质量管理规范》要求（C对）。（4）药品经营100%符合《药品经营质量管理规范》要求。（5）新开办零售药店均配备执业药师（D对）。2015年零售药店和医院药房全部实现营业时有执业药师指导合理用药。